中医理论认为“症”“证”“病”含义不同，下列表述中，属于“证”的是
A. 感冒
B. 咳嗽
C. 风寒犯肺
D. 鼻痒喷嚏
E. 恶寒发热

正确答案：C。风寒犯肺

解析：本题考查的是症、证、病的概念。中医理论认为“症”“证”“病”含义不同，下列表述中，属于“证”的是风寒犯肺（C对）。症，指疾病的外在表现，即症状。病，即疾病的简称，指有特定的致病因素、发病规律和病机演变的异常生命过程，具有特定的症状和体征。所谓“证”，是机体在疾病发展过程中某一阶段的病机概括，包括病变的部位、原因、性质以及邪正关系，能够反映出疾病发展过程中某一阶段的病机变化的本质，因而它比症状能更全面、更深刻、更准确地揭示出疾病的发展过程和本质。风寒犯肺证的临床表现及辨证要点：风寒犯肺证的临床表现，常见咳嗽（B错）或气喘，咳痰稀薄，色白而多泡沫，口不渴，常伴有鼻流清涕，或发热恶寒，头痛身酸楚，舌苔薄白，脉浮或弦紧。一般以咳嗽兼见风寒表证为辨证要点。感冒（A错）属于病，喷嚏（D错）与发热（E错）为感冒的症状。感冒是感受风邪或时行病毒，卫表失和而导致的常见外感疾病，临床表现以鼻塞、流涕、喷嚏、头痛、恶寒、发热、全身不适、脉浮等为特征。西医学中普通感冒（伤风）、流行性感冒（时行感冒）及其他上呼吸道感染，有上述临床表现者可参考此内容辨证论治。